在咀嚼过程中，磨损的定义是
A. 牙面与食物之间的摩擦而造成牙齿缓慢地渐进性消耗
B. 牙面与牙面之间的摩擦而造成牙齿缓慢地渐进性消耗
C. 牙面与外物机械摩擦而造成牙体损耗
D. 牙面与外物机械摩擦而产生的外物机械损耗
E. 以上都对

正确答案：C。牙面与外物机械摩擦而造成牙体损耗

解析：本题考查磨损的定义。在咀嚼过程中，磨损的定义是牙面与外物机械摩擦而造成牙体损耗（C对）。磨损一般指牙齿表面与外物机械性摩擦而产生的牙体组织损耗（DE错）。牙面与食物之间的摩擦而造成牙齿缓慢地渐进性消耗（A错）、牙面与牙面之间的摩擦而造成牙齿缓慢地渐进性消耗（B错）均指的是磨耗的定义。